学校开展心理咨询的主要对象是
A. 校领导
B. 教师
C. 心理教师
D. 学生
E. 家长

正确答案：D。学生